谷粒中与纤维素平行分布的营养素为
A. 脂肪
B. 蛋白质
C. 矿物质
D. 维生素
E. 可溶性糖

正确答案：C。矿物质